对糖尿病者监测糖化血红蛋白，其理想指标应为
A. ＜6%
B. 6.5%～7.5%
C. ＜7%
D. ＜8%
E. ＜10%

正确答案：A。＜6%

解析：本题考查糖尿病的实验室检查。对糖尿病者监测糖化血红蛋白，其理想指标应为＜6%（A对）。检测糖化血红蛋白可了解过去3～4周的血糖水平，正常值为4.8%～6.0%。故本题选A。